体育课基本部分的脉搏宜为
A. 80～130次/分
B. 90～120次/分
C. 130～170次/分
D. 130～180次/分
E. 140～200次/分

正确答案：D。130～180次/分